脊髓后索的纤维排列由内向外依次为
A. 颈、胸、腰、骶
B. 腰、骶、颈、胸
C. 胸、腰、骶、颈
D. 骶、腰、胸、颈
E. 骶、颈、胸、腰

正确答案：D。骶、腰、胸、颈

解析：脊髓后索的纤维排列由内向外依次为骶、腰、胸、颈（D对）。